T细胞依赖抗原是
A. 刺激B细胞产生高水平抗体产生时依赖B细胞辅助的抗原
B. 刺激T细胞产生高水平抗体产生时依赖T细胞辅助的抗原
C. 刺激T细胞产生高水平抗体产生时依赖B细胞辅助的抗原
D. 刺激B细胞产生高水平抗体产生时依赖T细胞辅助的抗原
E. 刺激外源细胞产生高水平抗体产生时依赖T细胞辅助的抗原

正确答案：D。刺激B细胞产生高水平抗体产生时依赖T细胞辅助的抗原

解析：胸腺依赖性抗原（TD-Ag），又称T细胞依赖抗原，是刺激B细胞产生高水平抗体产生时依赖T细胞辅助的抗原。掌握“抗原基本概念、分类、超抗原及佐剂”知识点。